重度肾功能损害患者的肌酐清除率的范围是
A. 100～120
B. 60～100
C. 40～60
D. 10～40
E. 0～10

正确答案：E。0～10

解析：本题考查肌酐清除率。重度肾功能损害患者的肌酐清除率为＜10ml/min（E对）；轻度损害肾功能损害患者的肌酐清除率为40～60ml/min（C错）；中度损害肾功能损害患者的肌酐清除率10～40ml/min（D错）。